患者女，52岁，面色苍白、月经过多2个月。查体：贫血貌，四肢皮肤散在出血点。实验室检查：Hb：62g/L，WBC：2.9×10⁹/L，PLT：17×10⁹/L。分别在髂前及髂后上棘行骨髓穿刺涂片见有核细胞少，成熟淋巴细胞多见，胸骨穿刺涂片见骨髓增生尚活跃，粒、红二系成熟停滞于晚期阶段，全片未见巨核细胞。该患者最可能的诊断是
A. 巨幼细胞贫血
B. 再生障碍性贫血
C. 急性白血病
D. 缺铁性贫血
E. 原发免疫性血小板减少症

正确答案：B。再生障碍性贫血

解析：患者女，52岁，面色苍白、月经过多2个月。查体：贫血貌，四肢皮肤散在出血点。实验室检查：Hb：62g/L（＜正常110-150g/L），WBC：2.9×10⁹/L（＜正常4-10×10⁹/L），PLT：17×10⁹/L（＜正常100-300×10⁹/L），三系细胞减少。分别在髂前及髂后上棘行骨髓穿刺涂片见有核细胞少，成熟淋巴细胞多见，胸骨穿刺涂片见骨髓增生尚活跃，粒、红二系成熟停滞于晚期阶段，全片未见巨核细胞（造血细胞减少，非造血细胞比例升高）。三系细胞减少+皮肤黏膜及内脏出血+造血细胞减少，非造血细胞比例升高考虑诊断为再生障碍性贫血（B对）。巨幼红细胞贫血（A错）诊断要点为苍白、乏力+牛肉舌+手足对称性麻木。急性白血病（C错）的诊断要点为贫血、出血、发热、感染+白血病细胞浸润症状+原始细胞增多。缺铁性贫血（D错）的诊断要点为皮肤黏膜苍白+异食癖+匙状甲+血中铁减少。原发免疫性血小板减少症（E错）的诊断要点为血小板计数减少+巨核细胞成熟障碍。